可确诊尖锐湿疣的病理结果是
A. 猫头鹰细胞
B. 燕麦细胞
C. 挖空细胞
D. 苦否细胞
E. 镜影细胞

正确答案：C。挖空细胞

解析：尖锐湿疣的典型表现为表皮乳头瘤样增生伴角化不全，颗粒层和棘层上部细胞可有明显的空泡形成，胞质着色淡，核浓缩深染，核周围有透亮的晕，称为凹空细胞，又叫做挖空细胞（C对）。
记忆：猫头鹰 巨细胞病毒 挖空 尖锐湿疣 苦否 肝巨噬细胞 镜影 霍奇金淋巴瘤 燕麦 小细胞肺癌 阿萨夫小体 Aschaffe小体 风湿小体 风湿热